影响生物碱碱性强弱的因素有
A. 氮原子的电子云密度
B. 碳原子的电子云密度
C. 氮原子的杂化方式
D. 氢原子的立体障碍
E. 氢键效应

正确答案：A、C、E。氮原子的电子云密度；氮原子的杂化方式；氢键效应

解析：本题考查的是生物碱碱性强弱与分子结构的关系。影响生物碱碱性强弱的因素有氮原子的电子云密度（A对）、氮原子的杂化方式（C对）与氢键效应（E对）。生物碱碱性强弱与分子结构的关系：生物碱的碱性强弱与其分子中氮原子的杂化方式、电子云密度、空间效应以及分子内氢键形成等有关。